中国药典规定，应检查双酯型生物碱限量的药材是
A. 细辛
B. 甘草
C. 泽泻
D. 附子
E. 狗脊

正确答案：D。附子

解析：本题考查的是中药的毒性成分。中国药典规定，应检查双酯型生物碱限量的药材是附子（D对）。《中国药典》对毒性成分的测定多采用高效液相色谱法，如制川乌、制草乌、附子中的双酯型生物碱（以含新乌头碱、次乌头碱、乌头碱的总量计），马钱子中的士的宁，斑蝥中的斑蝥素等。千里光中的阿多尼弗林碱、川楝子和苦楝皮中的川楝素等毒性成分测定采用高效液相色谱-串联质谱法，解决了常规高效液相色谱法灵敏度较低、分离不理想的问题。细辛（A错）含有痕量的马兜铃酸Ⅰ，有肝肾毒性。《中国药典》对马兜铃酸Ⅰ进行限量检查，要求其含量不得过0.001%。甘草（B错）需进行铅、镉、砷、汞、铜测定，并规定甘草含铅不得过5mg/kg，镉不得过0.3mg/kg，砷不得过2mg/kg，汞不得过0.2mg/kg，铜不得过20mg/kg；还需测定有机氯农药残留量，总六六六（BHC）不得超过0.2mg/kg；总滴滴涕（DDT）不得超过0.2mg/kg；五氯硝基苯（PCNB）不得超过0.1mg/kg。